氧化钙（生石灰）灼伤，正确的急救处理是
A. 立即用5%碳酸氢钠溶液冲洗后，再用清水冲洗
B. 用饱和的氢氧化钙溶液冲洗
C. 用清水冲洗10～20分钟
D. 用1%～2%氯化钠溶液冲洗
E. 用植物油清除皮肤的颗粒，再用2%醋酸溶液冲洗

正确答案：E。用植物油清除皮肤的颗粒，再用2%醋酸溶液冲洗